毒物的空间结构与毒性大小的一般规律正确的是
A. 直链烃﹤支链烃
B. 环烃﹤链烃
C. 间位﹤邻位﹤对位
D. L-异构体﹤D-异构体
E. 以上均正确

正确答案：C。间位﹤邻位﹤对位